流行性感冒发病率曲线的横坐标是以什么为单位的
A. 小时
B. 日
C. 月
D. 旬
E. 年

正确答案：B。日